女，30岁。妊娠33周，反复阴道流血3次，量少于月经量，无腹痛不适，臀位。胎心正常，G8P3，曾人工流产4次。最可能的诊断是
A. 生理性子宫收缩
B. 先兆早产
C. 胎盘早剥
D. 前置胎盘
E. 早产临产

正确答案：D。前置胎盘

解析：妊娠晚期妇女，既往有多次流产史、多孕产次（前置胎盘高危因素），反复阴道流血，无腹痛不适，胎位清楚。据患者生育史、临床表现及查体，最可能的诊断是前置胎盘（C对）。早产可分为先兆早产和早产临产两个阶段：先兆早产（B错）指有规则或不规则宫缩，伴有宫颈管进行性缩短；早产临产（E错）则出现规则宫缩，伴有宫颈以下改变：①宫颈扩张1cm以上；②宫颈容受＞80%（P96）。胎盘早剥（C错）腹痛，尤以胎盘剥离处最明显，可伴有子宫张力增高和子宫压痛（P151）。